硬膜外隙麻醉时，药物作用于
A. 脊髓灰质后角
B. 脊髓丘脑束
C. 脊髓灰质前角
D. 脊神经根
E. 脊神经前支

正确答案：D。脊神经根

解析：硬脊膜与椎管内面的骨膜之间的间隙称硬膜外隙，硬膜外隙麻醉即将药物注入此间隙，以阻滞脊神经根（D对）内的神经传导。